脑脊液耳漏多见于
A. Le FortⅠ型骨折
B. Le FortⅡ型骨折
C. Le FortⅢ型骨折
D. 颧骨骨折
E. 颧弓骨折

正确答案：C。Le FortⅢ型骨折

解析：本题考查上颌骨骨折-Le FortⅢ型骨折。脑脊液耳漏多见于Le FortⅢ型骨折（C对）。上颌骨Le Fort骨折分为三类：Le FortⅠ型骨折是指骨折线自梨状孔水平、牙槽突上方向两侧水平延伸到上颌翼突缝（A错）；Le FortⅡ型骨折是指骨折自鼻额缝向两侧横过鼻梁、眶内侧壁、眶底和颧上颌缝，再沿上颌骨侧壁至翼突，波及颅前窝可出现脑脊液鼻漏（B错）；Le FortⅢ型骨折是指骨折自鼻额缝向两侧横过鼻梁、眶部，经颧额缝向后达翼突，形成颅面分离，多伴有颅底骨折或颅脑损伤，出现脑脊液耳漏。颧骨颧弓骨折临床表现为颧面部塌陷畸形、张口受限、复视、神经症状和瘀斑（DE错）。